女，20岁。无明显诱因出现右膝关节疼痛，活动轻度受限1周。查体：T36.6℃，P70次/分，R18次/分，BP100/70mmHg，双肺呼吸音清，未闻及干湿性啰音，心率70次/分，心律齐，未闻及杂音，腹软，无压痛，右大腿下端外侧压痛，皮温无明显异常。右股骨X线片：右股骨远端外侧溶骨性破坏、呈肥皂泡样改变，最可能的诊断是
A. 骨软骨瘤
B. 骨巨细胞瘤
C. 骨结核
D. 骨囊肿
E. 骨肉瘤

正确答案：B。骨巨细胞瘤

解析：年轻女性，右股骨X线片：右股骨远端外侧溶骨性破坏、呈肥皂泡样改变（骨巨细胞瘤的典型的X线特征），根据患者的病史、临表、体征和X线检查，最可能的诊断是骨巨细胞瘤（B对）。骨软骨瘤（A错）X线表现内生软骨瘤显示髓腔内有椭圆形透亮点，呈溶骨性破坏，皮质变薄无膨胀，溶骨区内有间隔或斑点状钙化影（P775）。骨结核（C错）X线检查对诊断骨与关节结核十分重要，但一般在起病6-8周后才有X线平片改变，故不能作出早期诊断。其特征性表现为区域性骨质疏松和周围少量钙化的骨质破坏病灶，周围可见软组织肿胀影（P752）。骨囊肿（D错）X线表现为干骺端圆形或椭圆形界限清楚的溶骨性病灶，骨皮质有不同程度的膨月长变薄，单房或多房性（图71-7），经常毗邻骨骺生长板，但不越过生长板（P779）。骨肉瘤（E错）X线可表现为不同形态，密质骨和髓腔有成骨性、溶骨性和混合性骨质破坏，骨膜反应明显，呈侵袭性发展，可见Codman角或呈"日光射线”形态（P777）。